低钾血症的病人，补钾后病情仍无改善时，应首先考虑缺乏
A. 镁
B. 磷
C. 钠
D. 氯
E. 钙

正确答案：A。镁

解析：肾小管上皮细胞中有Na⁺-K⁺-ATP酶，该酶需要Mg²⁺作为激活剂，缺镁可导致此处钾吸收障碍。临床上低钾常与低镁同时存在，故低钾血症的病人，补钾后病情仍无改善时，应首先考虑缺乏镁（A对）。